外用药品应贴有
A. 红色标记
B. 黄色标记
C. 绿色标记
D. 蓝色标记
E. 规定标记

正确答案：E。规定标记

解析：本题考查规定标记。麻醉药品、精神药品、医疗用毒性药品、放射性药品、外用药品和非处方药品等国家规定有专用标识的，其说明书和标签必须印有规定标记（E对）。在人工作业的库房储存药品，按质量状态实行色标管理：合格药品为绿色（C错），不合格药品为红色（A错），待确定药品为黄色（B错）。